新生儿期应接种的疫苗是
A. 乙脑疫苗
B. 破伤风抗毒素
C. 麻疹减毒活疫苗
D. 卡介苗、乙肝疫苗
E. 百、白、破三联疫苗

正确答案：D。卡介苗、乙肝疫苗

解析：本题考查新生儿期应接种的疫苗。新生儿期是指出生之后的0～28天，在这段时期应接种卡介苗、乙肝疫苗（D对ABCE错）。